双嘧达莫的药理作用为
A. 抑制血小板功能
B. 溶解纤维蛋白
C. 抑制凝血因子合成
D. 激活抗凝血酶
E. 加速凝血因子耗竭

正确答案：A。抑制血小板功能

解析：本题考查双嘧达莫。双嘧达莫为磷酸二脂酶抑制剂，能够抑制血小板聚集（A对），对抗血栓形成。纤维蛋白溶解药能够溶解纤维蛋白（B错），发挥抗凝作用。维生素K拮抗剂能够通过抑制凝血因子合成（C错）发挥抗凝作用。激活抗凝血酶（D错）为肝素的抗凝机制。双嘧达莫不可加速凝血因子耗竭（E错）。